关于肝素的叙述，错误的是
A. 抗凝血作用缓慢而持久
B. 体内、体外均有抗凝血作用
C. 临床用于防治血栓栓塞性疾病
D. 临床用于弥漫性血管内凝血症的高凝期
E. 常用给药途径为皮下注射或静脉给药

正确答案：A。抗凝血作用缓慢而持久

解析：本题考查肝素。肝素起效迅速，作用持续时间较短（A错，为本题正确答案），在体内外都有抗凝血作用（B对）。临床上主要用于血栓栓塞性疾病（C对）、弥漫性血管内凝血症的高凝期（D对）、心肌梗死、心血管手术等，常皮下注射或静脉给药（E对）。